有关肋间神经的描述，何者正确
A. 肋间神经共12对
B. 肋间神经走行于肋间血管的上方
C. 肋间神经的肌支可支配肋间肌和腹肌的前外侧群
D. 肋间神经由脊神经的前后支共同组成
E. 无

正确答案：C。肋间神经的肌支可支配肋间肌和腹肌的前外侧群

解析：第1-11对胸神经前支（D错）位于相应的肋间隙中（B错），称为肋间神经，共11对（A错）。肋间神经的肌支分布于肋间肌和腹前外侧壁肌群（C对）。